B级）患者的推荐起始剂量为每次50mg，每天两次。在患者能够耐受的情况下，可以每2～4周倍增一次本品剂量，直至达到目标维持剂量每次200mg，每天两次。根据说明书判断，可用沙库巴曲缬沙坦治疗
A. 患者，男， 47岁，慢性心力衰竭， LVEF=35%，血压120/65mmHg
B. 患者，男，47岁，诊断为高血压，生活方式干预无效，随机血压155/95mHg
C. 患者，男，47岁，诊断为难治性高血压，使用依那普利、氢氯噻嗪、氨氯地平治疗仍未达标
D. 患者，男，47岁，慢性心力衰竭伴高钾血症(血K⁺5.8mmo/L，LVEF=38%）
E. 患者，男，47岁，慢性心力衰竭，血压87/65mmHg

正确答案：A。患者，男， 47岁，慢性心力衰竭， LVEF=35%，血压120/65mmHg

解析：本题考查沙库巴曲缬沙坦。由题目可知，沙库巴曲缬沙坦钠片的适应证为用于射血分数降低的慢性心力衰竭(NYHA Ⅱ一IV级，LVEF≤40%）成人患者，降低心血管死亡和心力衰竭住院的风险。患者，男， 47岁，慢性心力衰竭， LVEF=35%，血压120/65mmHg（A对）符合。